人为排除呼吸因素干扰的指标是
A. SB
B. pH
C. PaC02
D. AB
E. AG

正确答案：A。SB

解析：人为排除呼吸因素干扰的指标是SB（A对）。